男孩，8岁。少尿、肉眼血尿3天。2周前曾患化脓性扁桃体炎。查体：BP130/105mmHg。尿常规：尿蛋白（++），RBC（++++），该病活动期的主要治疗措施是
A. 补充液体
B. 使用利尿剂
C. 休息和控制感染
D. 使用激素和免疫抑制剂
E. 采用透析疗法

正确答案：C。休息和控制感染

解析：患儿8岁幼童（急性肾炎好发年龄段），急性起病，肉眼血尿伴少量蛋白尿、少尿3天，查体：BP130/105mmHg（2级高血压）。据患者年龄，临床表现和体征最可能的诊断为：急性肾小球肾炎。该病具有自限性，一般无特异治疗，休息和控制感染为主要措施（C对）。对少尿、水肿、高血压采取对症治疗，可控制水、盐入量（A错）；若无效，则用氢氯噻嗪（B错）。不使用激素和免疫抑制剂（D错）或采用透析疗法（E错）。